男，70岁，直肠指诊前列腺有一硬结，血清PSA20ng/ml。为明确诊断应采取的检查方法是
A. MRI
B. 前列腺穿刺活检
C. 经直肠B型超声
D. 检查CT
E. 放射性核素扫描

正确答案：B。前列腺穿刺活检

解析：患者直肠指诊有硬结，PSA大于20ng/ml（PSA是前列腺癌重要的血清标志物，正常参考值为0~4ng/ml），故考虑患者可能为前列腺癌。为明确诊断应采取的检查方法是前列腺穿刺活检（B对），这是病理确诊前列腺癌的主要方法。